盐酸氯丙嗪的化学名为
A. N，N-二甲基-2-氯-10H-吩噻嗪-10-丙胺盐酸盐
B. N，N-二乙基-2-氯-10H-吩噻嗪-10-丙胺盐酸盐
C. N，N-二异丙基-2-氯-10H-吩噻嗪-10-丙胺盐酸盐
D. N，N-二乙基-3-氯-10H-吩噻嗪-10-丙胺盐酸盐
E. N，N-二甲基-8-氯-10H-吩噻嗪-10-丙胺盐酸盐

正确答案：A。N，N-二甲基-2-氯-10H-吩噻嗪-10-丙胺盐酸盐